下列哪项不属于健康促进的基本特征
A. 强调个人的责任
B. 涉及整个人群的社会生活的各个方面
C. 以健康教育为先导
D. 避免暴露于健康的危险因素，全面促进健康
E. 强调对行为的干预和行为改变所需要的支持

正确答案：A。强调个人的责任